参与Ⅰ型超敏反应的Ig是
A. IgG
B. IgA
C. IgM
D. IgD
E. IgE

正确答案：E。IgE